RDA的基础是
A. 生理需要量
B. 最低需要量
C. 平均需求量
D. 适宜摄入量
E. 可耐受最高摄入量

正确答案：A。生理需要量